珍珠不具有的功效是
A. 安神定惊
B. 明目除翳
C. 解毒敛疮
D. 润肤祛斑
E. 平肝潜阳

正确答案：E。平肝潜阳

解析：本题考查的是安神药珍珠的功效。珍珠不具有的功效是平肝潜阳（E错，为本题正确答案）。珍珠：【功效】安神定惊（A对），明目除翳（B对），解毒敛疮（C对），润肤祛斑（D对）。平肝潜阳为磁石的功效。磁石：【功效】镇惊安神，平肝潜阳，聪耳明目，纳气平喘。